制备复合树脂充填洞形时应注意
A. 点线角应圆钝，洞缘釉质壁应制成斜面，倒凹宜呈圆弧形
B. 底要平，洞壁要直，洞形必须要深
C. 要去尽无基釉质，增加抗力形
D. 为制备获得良好的固位形，必须磨除正常的牙体组织
E. 无需去尽无基釉质，也无需在洞缘角制备短斜面

正确答案：A。点线角应圆钝，洞缘釉质壁应制成斜面，倒凹宜呈圆弧形

解析：本题考查复合树脂修复的牙体预备的特点。用复合树脂充填时，牙体预备除要具备一般的抗力形和固位形外，还应注意点线角应圆钝防止应力集中，洞缘釉质壁应制成斜面以增加粘结面积，倒凹宜呈圆弧形（A对）。窝洞的深度根据病损深度而定，不必过分强调洞底的平整，没有统一深度（B错）。复合树脂多用于前牙的充填修复，前牙受力较小，可保留部分坚固的无基釉，以增加美观（C错）。复合树脂主要依靠粘接固位，对固位形的要求相对较低，不必过多的磨除正常的牙体组织（D错）。洞缘制备成短斜面，可减少微渗漏，增加粘接力及美观（E错）。